小儿疾病谱中最为多见的是
A. 肺肾系病证
B. 心肺系病证
C. 肺脾系病证
D. 心肝系病证
E. 肝肾系病证

正确答案：C。肺脾系病证

解析：小儿肺脏娇嫩，卫表不固，易感外邪，加之小儿肺气宣发功能尚不健全，又冷暖不自知或调护失宜，最易感外邪犯肺。小儿脾常不足，喂养不当或饮食失节，则出现受纳、腐熟、精微化生转输的异常，导致呕吐、泄泻、腹痛、积滞、厌食等脾系病证（C对）（ABDE错）。